影响中药质量变异的因素有
A. 空气
B. 日光
C. 霉菌
D. 包装容器
E. 贮存时间

正确答案：A、B、C、D、E。空气；日光；霉菌；包装容器；贮存时间

解析：本题考查的是环境因素对中药质量变异的影响。影响中药质量变异的因素有空气（A对）、日光（B对）、霉菌（C对）、包装容器（D对）与贮存时间（E对）。药材、饮片、中成药在贮藏过程中，由于受到外界诸多因素的影响，其质量也会不断发生变化。这些外界因素包括：1.温度；2.湿度；3.日光；4.空气；5.霉菌；6.虫害；7.包装容器；8.贮存时间。